位于翼下颌间隙的上方，处于颌面部诸间隙中央的间隙是
A. 眶下间隙
B. 颊间隙
C. 咬肌间隙
D. 翼下颌间隙
E. 颞下间隙

正确答案：E。颞下间隙

解析：本题考查面部筋膜间隙及其连通。颞下间隙位于翼下颌间隙的上方，处于颌面部诸间隙中央的间隙（E对）。颞间隙感染常与相邻间隙感染同时存在。眶下间隙位于眼眶前部的下方（A错）。颊间隙位于颊肌与咬肌之间（B错）。咬肌间隙位于咬肌和下颌支之间（C错）。翼下颌间隙位于下颌支与翼内肌之间（D错）。